有关早期胃癌的叙述，正确的是
A. 直径<1.0cm的胃癌为早期胃癌
B. 浸润仅限于黏膜层
C. 浸润不超过黏膜下层
D. 病理类型以未分化癌为多见
E. 多呈息肉状

正确答案：C。浸润不超过黏膜下层

解析：符合早期胃癌诊断条件的是肿瘤仅限于黏膜层或黏膜下层，癌未累及肌层（C对）